充填后嵌塞的原因如下，除了
A. 未恢复接触点
B. 邻牙有龋坏
C. 外展隙小
D. 充填体悬突
E. 充填时用了成形片

正确答案：E。充填时用了成形片

解析：本题考查充填后嵌塞的原因。充填时用了成形片，利于形成良好的接触，防止食物嵌塞（E错，为本题的正确答案）。未恢复接触点，两邻牙间存在间隙易造成食物嵌塞（A对）。邻牙有龋坏，龋坏部位质地粗糙，不易清洁，易滞留食物残渣（B对）。外展隙小不利于食物正常排溢，造成食物嵌塞（C对）。充填体悬突可使食物卡在悬突充填体与邻牙间（D对）。